不符合幼儿急疹特点的是
A. 高热时可有惊厥
B. 红色斑丘疹颈及躯干多见
C. 可有耳后淋巴结肿大
D. 出疹期热度更高
E. 高热3～5天

正确答案：D。出疹期热度更高

解析：幼儿急疹一般情况好，高热3～5天（E对），可有惊厥（A对）。皮疹为红色细小密集斑丘疹，头面颈及躯干多见（B对），四肢较少，一天出齐，次日开始消退。发热与皮疹的关系为热退疹出（D错，为本题正确答案）。出疹期热更高的是麻疹，出疹时为发热高峰。